男，31岁。右小腿被撞伤，创口出血，骨外露24小时X线片示右胫腓骨下段粉碎性骨折，容易出现的并发症是
A. 坠积性肺炎
B. 神经血管损伤
C. 骨筋膜室综合征
D. 感染
E. 急性骨萎缩

正确答案：D。感染

解析：患者右小腿骨折，骨外露24小时，其最易出现的并发症是感染（D对）。坠积性肺炎（A错）多见于骨折后长期卧床，年老体衰的病人。小腿开放性粉碎性骨折会造成神经血管损伤（B错）和骨筋膜室综合征（C错），但出现的几率不如感染高，并不是其最容易出现的并发症。急性骨萎缩（E错）是损伤所致关节附近的疼痛性骨质疏松，亦称反射性交感神经性骨营养不良，好发于手、足骨折后。